大多数皂苷共同的性质有
A. 苦味及辛辣味
B. 吸湿性
C. 易溶于氯仿
D. 能产生泡沫
E. 溶血性

正确答案：A、B、D、E。苦味及辛辣味；吸湿性；能产生泡沫；溶血性

解析：本题考查的是皂苷的理化性质。大多数皂苷共同的性质有苦味及辛辣味（A对）、吸湿性（B对）、能产生泡沫（D对）与溶血性（E对）。皂苷的理化性质：1.性状：（1）皂苷分子量较大，不易结晶，大多为无色或乳白色无定型粉末。（2）皂苷多数具有苦而辛辣味，其粉末对人体黏膜有强烈的刺激性，鼻内黏膜尤其敏感。（3）皂苷大多具有吸湿性，应干燥保存。（4）多数三萜皂苷都呈酸性。2.溶解度：大多数皂苷极性较大，易溶于水、热甲醇和乙醇等极性较大的溶剂，难溶于丙酮、乙醚等有机溶剂（C错）。3.发泡性：皂苷水溶液经强烈振荡能产生持久性的泡沫，且不因加热而消失。4.溶血性：皂苷的水溶液大多能破坏红细胞，产生溶血现象。5.熔点与旋光度：皂苷常在熔融前就已经分解，因此无明显的熔点，一般测的都是分解点。测定旋光度对判断皂苷的结构有重要意义。6.皂苷的水解：皂苷苷键的裂解，通常可采用一般苷类化合物苷键裂解的方法，如酸催化水解、氧化水解和酶解等。7.显色反应：皂苷通常应用的显色反应有Liebermann反应、醋酐-浓硫酸反应、三氯乙酸反应、五氯化锑反应及芳香醛-硫酸或高氯酸反应。